应用透析方法不能从人体内清除的药品是
A. 庆大霉素
B. 苯巴比妥
C. 头孢唑林
D. 万古霉素
E. 甲基多巴

正确答案：D。万古霉素

解析：本题考查特殊人群用药。应用透析方法不能从人体内清除的药品是万古霉素（D对）。不能由透析清除的药物有咪康唑、酮康唑、利福平、两性霉素B、头孢尼西、头孢哌酮、头孢曲松、氯唑西林、双氯西林、甲氧西林、苯唑西林、多西环素、米诺环素、万古霉素、克林霉素、红霉素、氯喹、洋地黄毒苷、地高辛、奎尼丁、利血平、可乐定、多塞平、二氮嗪、肼屈嗪、哌唑嗪、拉贝洛尔、硝苯地平、普萘洛尔、噻吗洛尔、硝酸异山梨酯、硝酸甘油、甲氧氯普胺、美沙酮、丙氧芬、阿米替林、丙米嗪、去甲替林、普罗替林、氯丙嗪、氟哌啶醇、卡马西平、苯妥英钠、丙戊酸钠、氮芥、苯丁酸氮芥、肝素、胰岛素。庆大霉素（A错）、苯巴比妥（B错）和甲基多巴（E错）属于血液和腹膜透析均可清除的药物。头孢唑林（C错）是能由血液透析清除但不能由腹膜透析清除的药物。